不协调性子宫收缩乏力时，首选药物应是
A. 硫酸镁静脉滴注
B. 哌替啶肌内注射
C. 肼苯达嗪静脉滴注
D. 甘露醇快速静滴
E. 氯丙嗪静脉推注

正确答案：B。哌替啶肌内注射

解析：不协调性子宫收缩乏力时，镇静剂哌替啶肌内注射（B对）能使产妇充分休息，醒后不协调性宫缩多能恢复为协调性宫缩。硫酸镁静脉滴注（P71）（A错）主要用于治疗子痫。肼苯达嗪静脉滴注（C错）用于扩张血管快速降压。甘露醇快速静滴（P71）（D错）主要用于降低颅内压。哌替啶、异丙嗪与氯丙嗪（P70）（E错）组成的冬眠药物肌内注射有助于解痉降压，控制子痫抽搐。